分布至头颈和上肢血管的交感神经节后纤维发自
A. 椎前神经节
B. 颈、胸交感干神经节
C. 颈交感干神经节
D. 胸交感干神经节
E. 以上都不是

正确答案：C。颈交感干神经节

解析：颈部交感干神经节（C对）发出的节后神经纤维经灰交通支连于8对颈神经，并随颈神经分支分布至头颈和上肢的血管、汗腺、竖毛肌等。